急性出血坏死型胰腺炎最有意义的检查是
A. 腹部平片
B. 腹部B超
C. 腹部CT
D. 血常规
E. 生化检查

正确答案：C。腹部CT

解析：急性出血坏死型胰腺炎，胰腺内有灰白色或黄色斑块的脂肪坏死，出血严重者，胰腺呈棕黑色并伴有新鲜出血，坏死灶外周有炎症细胞浸润。腹部B超（B错）是急性胰腺炎的常规初筛影像学检查，常因受胃肠道积气的干扰，对胰腺形态观察不满意，影响诊断的准确性。腹部CT（C对）有助于确定有无胰腺炎，胰周炎性改变及胸、腹腔积液及胰腺的坏死程度。生化检查（E错）示：血糖＞11.2mmol/L，血钙＜2mmol/L，可用于间接诊断急性出血坏死型胰腺炎。腹部平片（A错）对于观察胰腺形态意义不大，主要用于消化道穿孔、肠梗阻等的诊断。血常规（D错）为一般性检查，急性水肿型和急性出血坏死型胰腺炎均会显示白细胞升高，不具有特异性。